肛温＜30度的新生儿寒冷治疗后恢复正常体温的时间是
A. 6～12小时
B. 10～12小时
C. 12～24小时
D. 24～36小时
E. 36～48小时

正确答案：C。12～24小时

解析：当肛温＜30℃时提示体温很低，棕色脂肪被耗尽，应将患儿置于箱温比肛温高1～2℃的暖箱中进行外加温，每小时提高箱温0.5～1℃（箱温不超过34℃）在12～24小时内（C对）恢复正常体温。